药用部分为根和根茎的药材是
A. 绵马贯众
B. 细辛
C. 威灵仙
D. 党参
E. 白薇

正确答案：B、C、E。细辛；威灵仙；白薇

解析：本题考查的是细辛、威灵仙、白薇的药用部位。药用部分为根和根茎的药材是细辛（B对）、威灵仙（C对）与白薇（E对）。细辛：【来源】为马兜铃科植物北细辛、汉城细辛或华细辛的干燥根和根茎。前两种习称“辽细辛”。威灵仙：【来源】为毛茛科植物威灵仙、棉团铁线莲或东北铁线莲的干燥根和根茎。白薇：【来源】为萝藦科植物白薇或蔓生白薇的干燥根和根茎。绵马贯众（A错）：【来源】为鳞毛蕨科植物粗茎鳞毛蕨的干燥根茎和叶柄残基。党参（D错）：【来源】为桔梗科植物党参、素花党参或川党参的干燥根。